下列疾病，可见板状腹的是
A. 急性阑尾炎
B. 急性胆囊炎
C. 肠结核
D. 急性胃肠穿孔
E. 大量腹水

正确答案：D。急性胃肠穿孔

解析：急性胃肠穿孔（D对）或实质脏器破裂所致急性弥漫性腹膜炎，因炎症刺激腹膜引起腹肌反射性痉挛，腹壁常有明显紧张，甚至强直硬如木板，称为板状强直。急性阑尾炎（A错）是外科常见病，居各种急腹症的首位。转移性右下腹痛及阑尾点压痛、反跳痛为其常见临床表现，但是急性阑尾炎的病情变化多端。其临床表现为持续伴阵发性加剧的右下腹痛、恶心、呕吐，多数病人白细胞和嗜中性粒细胞计数增高，右下腹阑尾区（麦氏点）压痛，则是该病重要体征。急性胆囊炎（B错）是由于胆囊管阻塞和细菌侵袭而引起的胆囊炎症；其典型临床特征为右上腹阵发性绞痛，伴有明显的触痛和腹肌强直，常有墨菲氏征阳性。肠结核（C错）腹壁常有揉面感。大量腹水（E错）可见移动性浊音阳性。